下列各组药物中，属于配伍禁忌的是
A. 巴豆与牵牛
B. 丁香与三棱
C. 牙硝与郁金
D. 官桂与五灵脂
E. 人参与赤石脂

正确答案：A。巴豆与牵牛

解析：十九畏歌：硫黄原是火中精，朴硝一见便相争，水银莫与砒霜见，狼毒最怕密陀僧，巴豆性烈最为上，偏与牵牛不顺情，丁香莫与郁金见，牙硝难合京三棱，川乌、草乌不顺犀，人参最怕五灵脂，官桂善能调冷气，若逢石脂便相欺，大凡修合看顺逆，炮熞炙煿莫相依。硫黄畏朴硝，水银畏砒霜，狼毒畏密陀僧，巴豆畏牵牛（A对），丁香畏郁金（B错），川乌、草乌畏犀角，牙硝畏三棱（C错），官桂畏石脂（D错），人参畏五灵脂（E错）。